支配阑尾的神经是交感神经腹腔丛和
A. 内脏小神经
B. 第10胸神经
C. 第12胸神经
D. 内脏大神经
E. 第1腰神经

正确答案：A。内脏小神经

解析：阑尾的神经受交感神经腹腔丛和内脏小神经（A对）支配，传入脊髓的第10、11节段。